患者，男，42岁。转移性右下腹痛5小时。检查：发热，体温37.5℃，右下腹压痛，反跳痛，肌紧张，血白细胞计数及中性粒细胞比例均增高。应首先考虑的是
A. 十二指肠溃疡穿孔
B. 急性胆囊炎
C. 急性胰腺炎
D. 急性肠系膜淋巴结炎
E. 急性阑尾炎

正确答案：E。急性阑尾炎

解析：患者转移性右下腹痛，反跳痛，肌紧张，血白细胞计数及中性粒细胞比例均增高应首先考虑的是急性阑尾炎，是由于梗阻和感染等因素造成（E对）。穿孔发生之前数天往往上腹痛加重，一旦溃疡突然穿破，病人顿觉上腹部剧痛，疼痛难以忍受，疼痛可放散至后背或右肩。刺激横膈的顶部，病人觉肩部酸痛；刺激胆囊后方的膈肌与腹膜，病人觉右肩胛骨下方疼痛；刺激小网膜腔，病人仅觉相应下背痛。当胃肠内容弥散至全腹时，则引起全腹持续性剧痛。由于大量胃肠内容是沿右结肠旁沟流至右髂窝，故此处的症状特别明显，易误诊为阑尾炎（A错）。急性胆囊炎是由于胆囊管阻塞和细菌侵袭而引起的胆囊炎症；其典型临床特征为右上腹阵发性绞痛，伴有明显的触痛和腹肌强直（B错）。急性胰腺炎临床以急性上腹痛、恶心、呕吐、发热和血胰酶增高等为特点。病变程度轻重不等，轻者以胰腺水肿为主，临床多见，病情常呈自限性（C错）。急性肠系膜淋巴结炎常见于儿童和青少年，以发烧、急性腹痛为其临床特点（D错）。